不属于乌梅丸的方药配伍特点的是
A. 寒热并用
B. 补泻同施
C. 气血兼顾
D. 散收结合
E. 酸苦辛并用

正确答案：B。补泻同施

解析：乌梅丸的配伍特点有酸苦辛并进，寒热并用，本方药物组成没有泻下药，不能泻下（B对AE错）。方中当归、人参补气养血（C错）。方中君药乌梅酸收涩肠，附子、桂枝、干姜温脏散寒，为散收结合之法（D错）。